根据《药品召回管理办法》药品生产企业在启动药品召回后，应当将调查评价告和召回计划提交，所在地药品监督管理部门的时限是，一级召回在
A. 1日内
B. 2日内
C. 3日内
D. 7日内
E. 10日内

正确答案：A。1日内

解析：本题考察药品召回管理。药品生产企业在启动药品召回后，一级召回在1日内（A对），二级召回在3日内，三级召回在7日内，应当将调查评估报告和召回计划提交给所在地省、自治区、直辖市药品监督管理部门备案。